小陷胸汤主治证候中有
A. 痰白而稀
B. 干咳无痰
C. 咳痰黄稠
D. 痰中带血
E. 咳嗽痰多

正确答案：C。咳痰黄稠

解析：本题考查小陷胸汤的主治。小陷胸汤为祛痰剂，具有清热化痰，宽胸散结之功效。主治痰热互结之结胸证。胸脘痞闷，按之则痛，或心胸闷痛，或咳痰黄稠，舌红苔黄腻，脉滑数（C对）。趣记：小陷胸汤连夏蒌。